阴跷脉阳跷脉的主要功能有
A. 调节阳经气血
B. 调节阴经气血
C. 调节十二经气血
D. 维系全身阴阳经脉
E. 司眼睑之开合

正确答案：E。司眼睑之开合

解析：“跷”，有轻捷矫健之意，跷脉可主司下肢运动；同时阴跷脉和阳跷脉交会于目内眦，故又主司眼睑开合（E对）。